下列有关TI-Ag说法不正确的是
A. 只能引起体液免疫应答
B. 不诱导免疫记忆
C. 主要刺激IgA类抗体的产生
D. 聚合鞭毛素是TI-Ag
E. 细菌脂多糖是TI-Ag

正确答案：C。主要刺激IgA类抗体的产生

解析：胸腺非依赖性抗原（TI-Ag）是指无需T细胞辅助即可直接刺激B细胞产生抗体的抗原。细菌脂多糖、肺炎球菌荚膜多糖和聚合鞭毛素等是TI-Ag。TI-Ag只能引起体液免疫应答，主要刺激IgM类抗体的产生，不诱导免疫记忆。将TI-Ag和蛋白分子偶联可使TI-Ag获得强效刺激针对TI-Ag的体液免疫应答的能力。多糖偶联疫苗就是根据这一原理研制的。掌握“抗原基本概念、分类、超抗原及佐剂”知识点。